用于远中游离缺失的末端基牙，卡环不与鞍基直接相连的卡环
A. 回力
B. 倒钩
C. 联合
D. 圈形
E. 对半

正确答案：A。回力

解析：本题考查卡环。用于远中游离缺失的末端基牙，卡环不与鞍基直接相连的卡环是回力卡环（A对）。回力卡环位于基牙远中的卡体和支托部分不直接与游离鞍基相连，而是在其舌侧卡臂尖处通过小连接体与义齿支架相连，具有应力中断作用，可以减小游离端缺失末端基牙所受到的扭力和负担。倒钩卡环（B错）用于倒凹区在支托的同侧下方的基牙，又称下返卡环。当有软组织倒凹区无法使用杆形卡环时选用。联合卡环（C错）：卡环是可摘局部义齿直接固位体结构，是直接卡抱在基牙上的金属部分。其主要作用为防止义齿（牙合）向脱位，亦能防止义齿下沉、旋转、移位，也起一定支撑和稳定作用。由位于相邻两基牙上的2个卡环通过共同的卡环体相连而成的叫做联合卡环，此卡环需用铸造法制作。圈形卡环（D错）亦称环形卡环，多用于最后孤立的磨牙上，基牙向近中舌侧（多为下颌）或近中颊侧（多为上颌）倾斜。卡环游离臂端设在颊或舌面主要倒凹区，经过基牙远中延伸至舌面或颊面非倒凹区。铸造圈形卡环的近、远中分别或同时放置支托，并可以加宽非倒凹对抗臂或设计并行双臂，以提高其强度；对锻造者，非倒凹区用高基托，起对抗管作用，临床应用较多。对半卡环（E错）：由颊、舌侧两个相对的卡环臂和近、远中两个（牙合）支托所组成，以各自的小连接体分别连接于树脂基托中或铸造支架上。注意应将其中一个卡环臂设计为对抗臂，不宜将两个卡环臂都设计为固位臂。主要用于前后有缺隙、孤立的前磨牙或磨牙。